患者有慢性前列腺炎史3年，刻下症见：少腹、睾丸、会阴胀痛不适，舌有瘀点，脉细涩，治疗应首选的方剂是
A. 右归丸
B. 八正散
C. 抵当汤
D. 大分清饮
E. 前列腺汤

正确答案：E。前列腺汤

解析：题中患者有慢性前列腺炎史3年，少腹、睾丸、会阴胀痛不适为气滞不通造成，舌有瘀点，脉细涩为血瘀之象，故辨为气滞血瘀证；治宜活血化瘀，行气止痛，方用前列腺汤加减（E对）。右归丸（A错）为补益剂，具有温补肾阳，填精止遗之功效。八正散（B错）清热泻火，利水通淋，适用于前列腺炎之湿热下注证。抵当汤（C错）主治下焦蓄血所致的发狂或如狂。大分清饮（D错）功能清热利水通淋。